生物多样性锐减的危害在于
A. 生物数量减少
B. 生物遗传性状改变
C. 生物适应能力下降
D. 生物数量和种类都减少
E. 物种减少以致灭绝

正确答案：E。物种减少以致灭绝

解析：本题考查生物多样性锐减的危害。生物多样性锐减是指在一定的时间和空间内，物种的数量和种类大大减少。生物多样性的锐减将对生态系统的稳定性和功能造成严重的影响，危害范围涉及到生物的数量、遗传性状改变、适应能力下降以及物种减少和灭绝（E对ABCD错）等问题。